养肺胃之阴的药有
A. 麦冬
B. 玉竹
C. 天冬
D. 百合
E. 黄精

正确答案：A、B。麦冬；玉竹

解析：本题考查的是麦冬与玉竹的功效。养肺胃之阴的药有麦冬（A对）与玉竹（B对）。麦冬：【功效】润肺养阴，益胃生津，清心除烦，润肠通便。玉竹：【功效】滋阴润肺，生津养胃。天冬（C错）：【功效】滋阴降火，清肺润燥，润肠通便。百合（D错）：【功效】养阴润肺，清心安神。黄精（E错）：【功效】滋阴润肺，补脾益气。